导致人群肝癌的主要危险因素是
A. 甲肝病毒
B. 乙肝病毒
C. 微囊藻毒素
D. A＋B
E. B＋C

正确答案：E。B＋C

解析：本题考查导致人群肝癌的主要危险因素。肝癌即肝脏恶性肿瘤，可分为原发性和继发性两大类。乙肝病毒、微囊藻毒素（E对ABCD错）与肝癌发病有关，是人群肝癌的主要危险因素。